绒毛膜癌的主要转移途径是
A. 直接蔓延
B. 淋巴转移
C. 血行转移
D. 直接蔓延和种植
E. 直接蔓延和淋巴转移

正确答案：C。血行转移

解析：绒毛膜癌的主要转移途径为血行转移（C对），因其侵袭破坏血管能力很强。直接蔓延（A错）为肿瘤从原发部位直接侵入周围组织和器官，绒毛膜癌以破坏血管为主。淋巴转移（BE错）为上皮组织恶性肿瘤最常见的转移方式，绒毛膜癌不属于上皮组织来源的恶性肿瘤。种植性转移（D错）发生于体腔内器官的恶性肿瘤，侵及器官表面时，癌细胞脱落后播散到体腔其他器官的一种转移方式。